小儿疾病的治疗原则不包括
A. 身心兼顾，综合治疗
B. 中病即止，合理调护
C. 注意顾护脾胃
D. 足量用药，避免复发
E. 中西医结合，取长补短

正确答案：D。足量用药，避免复发

解析：由于小儿在解剖、生理、病理和疾病恢复过程等方面都有明显的年龄特点，故在治疗时应遵循以下原则：发挥中西医优势，取长补短（E对）；治疗要及时、正确和审慎；中病即止，顾护脾胃（C对）；注意整体治疗，合理调护（B对），由于小儿心神怯弱，心理承受能力差，更应注意身、心两方面的治疗（A对）。小儿用药精确，避免过剂，易耗伤小儿正气，故足量用药，避免复发不属于小儿疾病的治疗原则（D错，为本题正确答案）。